完带汤治疗带下过多的适应证是
A. 肾阳虚证
B. 阴虚夹湿证
C. 脾虚证
D. 湿热下注证
E. 热毒蕴结证

正确答案：C。脾虚证

解析：带下过多脾虚证，治以健脾益气，升阳除湿，可选用完带汤，此方来源于《傅青主女科》，原方治“终年累月下流白物，如涕如唾，不能禁止，甚则臭秽者，所谓白带也”完带汤以补脾疏肝，化湿止带为主，主治肝脾不和，带脉失约，湿浊下注。（C对）。带下过多肾阳虚证用内补丸（A错）。带下过多阴虚夹湿证用知柏地黄汤（B错）。带下过多湿热下注证用止带方（D错）。带下过多热毒蕴结证用五味消毒饮（E错）。